男，56岁，嗜酒。因近3个月疲乏无力、心悸、气促、全身水肿并逐渐加重而住院治疗。经强心、利尿、补充白蛋白、抗感染治疗1周后无效。医生考虑可能是由于缺乏某种营养索所致。为进一步确诊，需进行的生化检查是
A. 相对剂量反应试验
B. 红细胞溶血试验
C. 测定红细胞转酮醇酶活性
D. 测定红细胞谷胱甘肽还原酶活性
E. 测定尿中4-吡哆酸含量

正确答案：C。测定红细胞转酮醇酶活性